阻碍DNA合成的药物是
A. 紫杉醇
B. 顺铂
C. 氟尿嘧啶
D. 三尖杉酯碱
E. 放线菌素D

正确答案：C。氟尿嘧啶

解析：本题考查氟尿嘧啶。干扰核酸生物合成的药物是氟尿嘧啶（C对）。干扰核酸生物合成的药物：甲氨蝶呤、氟尿嘧啶、巯嘌呤、硫鸟嘌呤、羟基脲、阿糖胞苷等。紫杉醇（A错）、三尖杉酯碱（D错）为干扰蛋白质合成与功能的药物。顺铂（B错）为破坏DNA结构与功能的药物。放线菌素D（E错）为嵌入DNA干扰核酸合成的药物。